情志郁结不舒所致胸痛的特点是
A. 胸背彻痛
B. 胸痛喘促
C. 胸痛咳血
D. 胸痛走窜
E. 胸部刺痛

正确答案：D。胸痛走窜

解析：情志郁结不舒，胸中气机不利可导致胸痛走窜（D对）。胸背彻痛，面色青灰为真心痛，多由心脉急骤闭塞不通所致（A错）。胸痛喘促为肺实热证，为外感风热犯肺，肺失宣降所致（B错）。胸痛咳血为肺阴虚证，多由阴虚化燥生热，虚火灼肺所致（C错）。胸部刺痛，固定不移者，为血瘀为病，多由跌扑外伤，瘀血阻滞经络所致（E错）。